男婴，5个月，咳嗽1天，发热3小时。就诊过程中突然双目凝视，口吐白沫，四肢强直，呼之不应，持续1～2分钟缓解。查体：T39.3℃，咽红，心肺腹及神经系统无异常，最可能诊断是
A. 低钙惊厥
B. 中毒性脑病
C. 化脓性脑膜炎
D. 癫痫
E. 热性惊厥

正确答案：E。热性惊厥

解析：男婴，5个月（热性惊厥常发生在生后3个月～5岁），咳嗽1天，发热3小时。就诊过程中突然双目凝视，口吐白沫，四肢强直，呼之不应（惊厥表现），持续1～2分钟缓解（热性惊厥多于惊厥后神志很快恢复）。查体：T39.3℃（正常体温36～37℃），咽红，心肺腹及神经系统无异常。该患儿既往无热惊厥史，现有发热，神经系统无异常，且惊厥后神志很快恢复，最可能诊断是热性惊厥（E对）。低钙惊厥（A错）时，查电解质会显示低钙，且临床症状多偏向于四肢抽动。中毒性脑病（B错）早期会表现嗜睡、恶心、呕吐、意识障碍等，CT检查能提示相关病变。化脓性脑膜炎（C错）的血常规会提示白细胞增高，中性粒细胞占比多，呕吐等症状会比较明显。癫痫（D错）发作时的强直期表现为全身骨骼肌伸肌或曲肌强直性收缩伴意识丧失、呼吸暂停与发绀。